某医师选用草豆蔻治寒湿中阻之胀满疼痛，呕吐，泄泻，此因其除燥湿行气外，又能
A. 散风发表
B. 消积止呕
C. 温中止呕
D. 降逆止呕
E. 除痰截疟

正确答案：C。温中止呕

解析：本题考查的是草豆蔻的功效。某医师选用草豆蔻治寒湿中阻之胀满疼痛，呕吐，泄泻，此因其除燥湿行气外，又能温中止呕（C对）。草豆蔻：【功效】燥湿行气，温中止呕。荆芥：【功效】散风解表（A错），透疹止痒，止血。半夏：【功效】燥湿化痰，降逆止呕（D错），消痞散结。草果：【功效】燥湿温中，除痰截疟（E错）。功效为消积止呕（B错）的中药，2022年考试指南未明确说明。